下列关于九味羌活颗粒的说法错误的是
A. 不能通过一号筛与能通过四号筛的颗粒总和不得过15%
B. 处方中羌活、防风、苍术、细辛、川芎均采用双提法提取
C. 本品挥发油可采用喷雾方法加入
D. 应进行溶化性检查，并不得有焦屑
E. 应控制制剂的水分不得过8.0%

正确答案：A。不能通过一号筛与能通过四号筛的颗粒总和不得过15%

解析：本题考查颗粒剂的质量要求。水分除另有规定外，中药颗粒剂含水分不得过8.0%（E对）。粒度不能通过一号筛与能通过五号筛的总和不得过15%（A错，为本题正确答案）。九味羌活颗粒【注解】处方中羌活、防风、苍术、细辛、川芎中所含有的挥发油及水溶性成分为其有效成分，故采用双提法（B对）。本品挥发油采用喷雾方法加入（C对），应密闭至规定时间，待闷吸均匀化后包装。颗粒剂按上述方法检查，均不得有异物，中药颗粒还不得有焦屑（D对）。